温度刺激入洞出现疼痛，但刺激去除后疼痛立即消失，可能为
A. 深龋
B. 牙髓坏死
C. 可复性牙髓炎
D. 牙髓钙化
E. 慢性牙髓炎

正确答案：A。深龋

解析：深龋温度刺激的表现为，温度刺激入洞引起疼痛，刺激去除后疼痛立即消失，所以最可能的诊断为深龋。掌握“龋病的临床表现与分类”知识点。